关于戒烟管理的说法，正确的有
A. 行为干预效果较好
B. 必要时进行药物干预
C. 可使用一线戒烟药物可乐定戒断烟瘾
D. 可使用二线戒烟药物尼古丁替代制剂戒断烟瘾
E. 中医戒烟多采用联合治疗手段

正确答案：A、B、E。行为干预效果较好；必要时进行药物干预；中医戒烟多采用联合治疗手段

解析：本题考查戒烟管理。戒烟管理的方法如下：（1）行为干预：行为干预联合药物治疗能够有效帮助人们戒烟。此方法切实可行且效果较好（A对），值得推广。（2）必要时进行药物干预（B对）：戒烟药物能够有效帮助吸烟者戒断烟瘾，其包括一线戒烟药物（如尼古丁替代药物（D错）、安非他酮及伐尼克兰）、二线戒烟药物（如可乐定（C错）和去甲替林等）以及其他戒烟药物。（3）电子烟：电子烟作为烟草的替代品，其作用方式类似尼古丁替代疗法。（4）中医戒烟：传统中医在戒烟上能发挥比较好的作用，其中针刺戒烟已取得了一定疗效。近几年中医戒烟方法更多采用联合戒烟的治疗手段（E对），如针刺结合耳穴、推拿按摩、放血疗法、心理疏导等。